小儿腹泻伤食泻的治疗方剂为
A. 葛根黄芩黄连汤加减
B. 藿香正气散加减
C. 保和丸加减
D. 人参乌梅汤加减
E. 生脉散合参附龙牡救逆汤加减

正确答案：C。保和丸加减

解析：小儿腹泻伤食泻是由于患儿乳食不当，损伤脾胃所致，治疗时应运脾和胃，消食化滞，方药为保和丸加减（C对）。葛根黄芩黄连汤（A错）其功用为解表清里，适用于腹泻之湿热泻。藿香正气散（B错）其功用为解表化湿，理气和中，适用于腹泻之风寒泻。人参乌梅汤（D错）其功用为酸甘化阴，健脾止痢，适用于腹泻变证之气阴两伤证。生脉散合参附龙牡救逆汤（E错）适用于腹泻之阴竭阳脱证。